女，28岁，初孕，平素月经规律，妊娠40周，孕期检查正常，今自觉胎动减少，查体：T36.0℃，P70次/分，R20次/分，BP110/70mmHg，超声检查：羊水最大暗区2.5cm，指数7.0cm，检查：宫颈管未消，宫口未开，先露-3，胎心率120次/分。该孕妇临产开始后，胎心监护示有频繁晚期减速，最恰当的处理措施
A. 抑制宫缩
B. 加压给氧
C. 待宫口开全产钳助产
D. 继续观察产程
E. 剖宫产

正确答案：E。剖宫产

解析：成年女性患者，初孕，平素月经规律，妊娠40周，孕期检查正常，今自觉胎动减少，查体：T36.0℃（正常值36.0～37.0℃），P70次/分（正常值60～100次/分），R20次/分（正常值16～20次/分），BP110/70mmHg（正常值90～120/60～80mmHg），超声检查：羊水最大暗区2.5cm（正常值3～8cm），指数7.0cm（正常值5～18cm），检查：宫颈管未消，宫口未开，先露-3（胎头颅骨最低点在坐骨棘平面上3cm），胎心率120次/分（正常值110～160次/分）。综合患者的症状、体征和辅助检查，初步诊断为急性胎儿窘迫。该孕妇临产开始后，胎心监护示有频繁晚期减速，最恰当的处理措施剖宫产（E对）。抑制宫缩（A错）、加压给氧（B错）为一般处理。待宫口开全产钳助产（C错）有可能造成宝宝的脑损伤，从而留下脑瘫等后遗症，目前临床上已不再提倡。继续观察产程（D错）适用于正常分娩的患者。